吸入性肺脓肿最具特征的临床症状是
A. 咳嗽伴胸痛
B. 咳嗽伴咯血
C. 畏寒、高热
D. 呼吸困难
E. 咳大量脓臭痰

正确答案：E。咳大量脓臭痰

解析：吸入性肺脓肿的主要表现是畏寒、高热，体温达39℃～40℃，伴有咳嗽、咳黏液痰或大量脓臭痰。当炎症累积壁层胸膜时可引起胸痛，部分患者可有咯血，当肺脓肿破溃入胸腔时，可出现突发性的胸痛、气急，出现脓气胸，其中咳大量脓臭痰（E对）是吸入性肺脓肿最具特征的症状，在吸入性肺脓肿与细菌性肺炎的鉴别诊断中，当感染没有及时控制时，可咳出脓痰，而无大量脓臭痰。畏寒高热（C错）在各种细菌性感染性肺炎中均可见到。咳嗽伴咯血（B错）在当炎症累积肺部血管时可见到，也见于肺结核的病人。呼吸困难（D错）是呼吸系统的常见症状，并不具有特征性。咳嗽伴胸痛（A错）是在炎症累积胸膜，刺激肋间神经时引起，也不具有特征性。